胸廓的弹性回缩力成为吸气的弹性阻力见于
A. 深吸气
B. 深呼气
C. 平静呼气末
D. 胸廓处于自然位置时
E. 发生气胸时

正确答案：A。深吸气